治疗支原体肺炎热闭心神证，应首选
A. 桑菊饮与青霉素
B. 麻杏石甘汤与阿昔洛韦
C. 清营汤与红霉素
D. 生脉散与左氧氟沙星
E. 竹叶石膏汤与麦迪霉素

正确答案：C。清营汤与红霉素

解析：清营汤可以清热解毒，化痰开窍，用于治疗热闭心神证，西药中大环内酯类药物为首选，如红霉素、罗红霉素和阿奇霉素可以有效杀灭支原体（C对）。桑菊饮与青霉素（A错）用于治疗肺炎球菌肺炎邪犯肺胃证。麻杏石甘汤与阿昔洛韦（B错）用于治疗病毒性肺炎痰热壅肺证。生脉散与左氧氟沙星（D错）用于治疗支原体肺炎阴竭阳脱证。竹叶石膏汤与麦迪霉素（E错）用于治疗肺炎球菌肺炎正虚邪恋证。